抑制二氢叶酸合成酶的药物是
A. 青霉素
B. 磺胺甲噁唑
C. 甲氧苄啶
D. 红霉素
E. 异烟肼

正确答案：B。磺胺甲噁唑

解析：本题考查磺胺甲噁唑的作用机制。磺胺甲噁唑（B对）为磺胺类抗菌药，能够抑制二氢叶酸合成酶。青霉素（A错）通过抑制细菌细胞壁的合成发挥抗菌作用。甲氧苄啶（C错）抑制二氢叶酸还原酶。红霉素（D错）抑制细菌蛋白质的合成发挥抗菌作用。异烟肼（E错）通过抑制分枝菌酸的合成发挥抗菌作用。